建筑工人不慎坠楼，腰剧痛，双下肢感觉运动障碍，大小便功能障碍。经X线平片检查，诊断为胸腰段屈曲型压缩骨折并脊髓损伤，为进一步明确骨折偏向椎管内的移动情况，下列哪项检查是最有价值的
A. MRI
B. CT
C. ECT
D. 脊髓造影
E. X线断层摄影

正确答案：B。CT

解析：碎骨片在CT上呈高密度影，可明确显示出骨折片向椎管内的移动情况。因此，为进一步明确骨折片向椎管内的移动情况，最有价值的是CT（B对）。MRI（A错）、脊髓造影（D错）主要用于检查脊髓的损伤情况。ECT（C错）主要用于恶性肿瘤骨转移的诊断。X线断层摄影即CT，故选项E也是正确的。